具有止血，抗血栓、抗脑缺血、改善微循环作用的中药是
A. 莪术
B. 当归
C. 芦荟
D. 麻黄
E. 三七

正确答案：E。三七

解析：本题考查的是三七的药理作用。具有止血，抗血栓、抗脑缺血、改善微循环作用的中药是三七（E对）。三七的药理作用：（1）止血；（2）抗血栓；（3）扩张血管，改善微循环；（4）抗心肌缺血、抗脑缺血、抗动脉粥样硬化。莪术（A错）的药理作用：（1）抗肿瘤；（2）扩张血管、改善微循环；（3）改变血液流变性、抗血栓。当归（B错）具有抗贫血、增强免疫功能，调节血压，降血脂等作用。芦荟（C错）主要蒽醌类成分的药理作用：大黄酸有抑菌、抗病毒作用，大黄素、芦荟大黄素有抗肿瘤的作用，芦荟酸和芦荟泻素的药用价值为健胃和通便，芦荟霉素具有抗癌、抗病毒、抗菌的作用。麻黄（D错）的药理作用：（1）发汗；（2）平喘、镇咳、祛痰；（3）利尿；（4）解热、镇痛、抗炎。